男，36岁。双侧颈部淋巴结肿大伴发热1周。查体：T38.4℃，颈部和右侧腹股沟区可触及数枚肿大淋巴结，最大3cm×2cm，均活动、无压痛，心肺未见异常，腹平软，肝肋下未触及，脾肋下2cm。实验室检查：Hb128g/L,WBC6.0×10⁹/L,Plt120×10⁹/L，左侧颈部淋巴结活检查可见R-S细胞。霍奇金淋巴瘤化疗首选的方案是
A. ABVD方案
B. CHOP方案
C. MOPP方案
D. VDP方案
E. DA方案

正确答案：A。ABVD方案

解析：患者青年男性，双侧颈部淋巴结肿大伴发热1周，淋巴结活检可见R-S细胞，诊断为霍奇金淋巴瘤，霍奇金淋巴瘤首选化疗方案是ABVD方案（A对）。